治咳喘痰黄，宜选用的药是
A. 归脾经的热性药
B. 归肺经的寒性药
C. 归心经的温性药
D. 归大肠经的寒性药
E. 归小肠经的寒性药

正确答案：B。归肺经的寒性药

解析：本题考查的是归经对临床用药的指导意义。治咳喘痰黄，宜选用的药是归肺经的寒性药（B对）。归经对临床用药的指导意义：掌握归经，有助于提高用药的准确性，使临床用药更加合理。首先，指导医生根据疾病表现的病变所属脏腑经络而选择用药。如热证有肺热、肝热等不同，治肺热咳喘，即选归肺经而善清肺热的黄芩、桑白皮等；治肝热或肝火证，即选归肝经而善清肝火的龙胆草、夏枯草等。其次，指导医生根据脏腑经络病变的传变规律选择用药。由于脏腑经络的病变可以互相影响，临床治疗各种病证并不是某经病单纯使用某经药，还要根据脏腑经络之间的生理关系和疾病传变规律，选择归他经的药与之相配进行治疗。如咳嗽痰喘，治疗时就不能只选用归肺经的药，若为肝火犯肺所致，常以归肺经能清肺化痰的海蛤粉与归肝经能清热凉肝的青黛同用，使肝肺两清，咳喘早愈；若兼脾虚者，又当以归肺经的止咳化痰药与归脾经的健脾药同用，使痰消咳喘早愈。